患者，男，20岁。咳嗽伴低热，盗汗，乏力1个月。X线显示右肺上云雾状阴影。应首先考虑的是
A. 原发型肺结核
B. 血行播散型肺结核
C. 浸润型肺结核
D. 慢性纤维空洞型肺结核
E. 结核性胸膜炎

正确答案：C。浸润型肺结核

解析：患者为青年男性，低热、咳嗽、盗汗、乏力，提示为肺结核。且X线显示右肺上云雾状阴影，提示为浸润型肺结核（C对）。原发型肺结核X线表现为哑铃型（A错）。血行播散型肺结核X线表现为均匀的粟粒性结节（B错）。慢性纤维空洞型肺结核X线表现为垂柳征（D错）。结核性胸膜炎常伴胸腔积液，呼吸困难等（E错）。